药学人员与病人之间最基本的道德要求是
A. 敬业爱岗、尽职尽责
B. 尊重科学、精益求精
C. 不为名利、廉洁奉公
D. 语言亲切、态度和蔼
E. 尊重人格、保护患者

正确答案：A。敬业爱岗、尽职尽责